男，55岁。呕鲜血4小时，共2次，约200ml，黑便1次，约300g。查体：贫血貌，肝掌阳性，前胸可见数个蜘蛛痣。肝肋下未触及，脾肋下2cm，移动性浊音阳性。最适宜的药物止血措施是
A. 静脉应用生长抑素
B. 口服胃粘膜保护剂
C. 肌注维生素K
D. 静脉应用止血环酸
E. 静脉应用质子泵抑制剂

正确答案：A。静脉应用生长抑素

解析：中老年男性患者，肝掌、蜘蛛痣（肝功能减退，雌激素增多），脾大，移动性浊音阳性（腹水），考虑肝硬化、门静脉高压症。患者呕血、黑便，应诊断为食管胃底静脉曲张破裂出血。其出血大多汹涌，难以自行停止，首选血管收缩药或与血管扩张药硝酸酯类合用。静脉应用生长抑素（A对）可收缩内脏血管，减少内脏高动力循环，从而降低门脉压力，减少曲张静脉血流，为出血停止创造必要条件。口服胃粘膜保护剂（B错）多用于胃十二指肠溃疡出血，能够保护胃黏膜，促进溃疡愈合。肌注维生素K（C错）、静脉应用止血环酸（D错）为一般性辅助治疗，可以促进血液凝固，但胃底食管静脉曲张出血较汹涌，单独应用止血药物效果欠佳，须建立在降低出血速度的基础上。静脉应用质子泵抑制剂（E错）可高效快速抑制胃酸分泌，主要用于溃疡病等胃酸相关性疾病。